位于延髓内的脑神经核是
A. 滑车神经核
B. 三叉神经运动核
C. 面神经核
D. 展神经核
E. 疑核

正确答案：E。疑核

解析：脑神经核是在中枢神经系统内形态和功能相似的神经元胞体聚集在一起形成。除嗅、视神经外，脑干连有其余10对脑神经，这些脑神经在脑干内都有与之相应的脑神经核。延髓有第Ⅸ、Ⅹ、Ⅺ、Ⅻ对脑神经的核团，其中包括疑核（第Ⅸ、Ⅹ、Ⅺ 对脑神经的特殊内脏运动核）（E对）。滑车神经核（第Ⅳ对脑神经的核团）（A错）是位于中脑内的脑神经核。三叉神经核（第Ⅴ对脑神经的核团）（B错）、展神经核（第Ⅵ对脑神经的核团）（D错）、面神经核（第Ⅶ对脑神经的核团）（C错）均是位于脑桥内的脑神经核。